关于十二指肠的说法，何者正确
A. 上部为腹膜外位器官
B. 均由腹腔干供血
C. 分为上、中、下三部
D. 全长呈“c”形包绕胰头
E. 以上全对

正确答案：D。全长呈“c”形包绕胰头

解析：十二指肠上部为腹膜内位器官(A错)，降部和水平部属腹膜外位器官，除腹腔干外还由胰十二指肠下动脉分支供血(B错)，分为上部、降部、水平部和升部(C错)，全长呈“c”形包绕胰头(D对)。